疫疠邪气的特性是
A. 重浊
B. 干涩
C. 易流行
D. 升散
E. 收引

正确答案：C。易流行

解析：本题考查的是疫疠邪气的特性。疫疠邪气的特性是易流行（C对）。疠气，即疫疠邪气，是一类具有强烈传染性的外感致病邪气，又称“戾气”“异气”“毒气”“乖戾之气”等。疠气的致病特点：发病急骤、病情较重；一气一病、症状相似；传染性强、易于流行。重浊（A错）为湿邪的特性。湿邪的性质及致病特点：（1）湿为阴邪，易阻遏气机，损伤阳气；（2）湿性重浊；（3）湿性黏滞；（4）湿性趋下，易伤阴位。干涩（B错）为燥邪的特性。燥邪的性质及致病特点：（1）燥性干涩，易伤津液；（2）燥易伤肺。升散（D错）为暑邪的特性。暑邪的性质及致病特点：（1）暑为阳邪，其性炎热；（2）暑性升散，耗气伤津；（3）暑多挟湿。收引（E错）为寒邪的特性。寒邪的性质及致病特点：（1）寒为阴邪，易伤阳气；（2）寒性凝滞，主痛；（3）寒性收引。